不符合无菌操作规则的是
A. 术中手不能接触背部，腰部以下肩部以上的部位
B. 同侧手术人员换位，一人应先退后一步，然后平移换位
C. 手术进行时，不可开窗通风或用电扇
D. 作皮肤切口之前，需用70%酒精再消毒皮肤一次
E. 切开空腔脏器前，要用纱布垫保护周围皮肤一次

正确答案：B。同侧手术人员换位，一人应先退后一步，然后平移换位

解析：术中的无菌原则中，同侧手术人员换位，应该一人先退一步，然后背对背地转身到达另一位置，而不是平移换位，因为平移换位有可能会触及对方背部非无菌区（B错，为本题正确答案）。术中手不能接触背部、腰部以下和肩部以上的部位（A对）；手术进行时，不可开窗通风或用电扇（C对）；作皮肤切口之前，需用70%酒精再消毒皮肤一次（D对）；切开空腔脏器前，要用纱布垫保护周围皮肤（E对）均是术中应遵守的无菌原则。